女，66岁。乏力1个月。既往高血压病史4年。查体：BP150/70mmHg，心率67次/分，律齐。腹软，腹部未闻及血管杂音。实验室检查：血钾2.9mmol/L，血肾素水平降低，醛固酮水平增高。CT示左侧肾上腺增生。该患者的最适宜降压药物是
A. 氢氯噻嗪
B. 美托洛尔
C. 呋塞米
D. 螺内酯
E. 普萘洛尔

正确答案：D。螺内酯

解析：老年女性患者，出现乏力、高血压、低血钾（正常值为3.5mmol/L～5.5mmol/L）（原发性醛固酮增多症的典型症状）；血肾素水平降低、醛固酮水平增高（原发性醛固酮增多症的典型实验室检查表现），CT示左侧肾上腺增生。因此可诊断为原发性醛固酮增多症，原醛症患者药物治疗首选螺内酯治疗（D对），螺内酯可特异性阻断醛固酮受体，纠正低钾血症，降低血压。氢氯噻嗪、美托洛尔、呋塞米、普萘洛尔均有降压作用，但未从根本上阻断醛固酮的作用，仅作为对症治疗。